金某，女性，46岁。胸胁胀痛，咳唾引痛，呼吸困难，咳逆气喘息促，不能平卧，病侧肋间饱满，可见左侧胸廓隆起。舌苔薄白腻，脉沉弦，治疗应选用
A. 小青龙汤
B. 五苓散
C. 越婢加术汤
D. 十枣汤
E. 柴枳半夏汤

正确答案：D。十枣汤

解析：饮停于胸，气机阻滞不能运行故见胸胁胀痛，咳唾引痛；肺失清肃故见呼吸困难，咳逆气喘息促不能平卧；舌苔薄白腻，脉沉弦，均为饮停胸胁证的表现，治法为泻肺逐饮，方药选用十枣汤加减（D对）。小青龙汤（A错）可以解表散寒，温肺化饮，用于治疗外寒里饮证。五苓散（B错）可以利水渗湿，温阳化气，用于治疗伤寒太阳膀胱蓄水证，水湿内停之水肿、泄泻、小便不利，痰饮内停。越婢加术汤（C错）可以清肺化痰，降逆平喘，用于治疗痰热郁肺证。柴枳半夏汤（E错）可以和解少阳，宣利枢机，用于治疗邪犯胸肺证。